初孕妇，27岁。妊娠38周，骨盆外测量：骶耻外径19.0cm，髂棘间径20cm，髂嵴间径28cm，坐骨棘间径9cm，坐骨结节间径7cm。该孕妇的骨盆应诊断是
A. 均小骨盆
B. 漏斗型骨盆
C. 扁平型骨盆
D. 类人猿型骨盆
E. 佝偻病性扁平骨盆

正确答案：B。漏斗型骨盆